患儿，2岁。泻下无度，小便短赤少，皮肤干燥，啼哭无泪，齿干唇红。其治法是
A. 温阳救逆
B. 滋阴潜阳
C. 补脾温肾
D. 酸甘敛阴
E. 救逆固脱

正确答案：D。酸甘敛阴

解析：患儿泻下无度，耗伤阴液，虚火内生，则见小便短赤少，皮肤干燥，啼哭无泪，齿干唇红，可诊断为泄泻变证之气阴两伤，治宜酸甘敛，阴急救阴液（D对）。温阳救逆适于心肾阳衰寒厥证（A错）。滋阴潜阳适于肝肾阴虚而致的肝阳偏亢证（B错）。补脾温肾适于脾肾阳虚所致的泄泻（C错）。救逆固脱适于泄泻过度所致的阴竭阳脱证（E错）。